急性发病的认知损害、行为改变、情感障碍，提示为
A. 基底节出血
B. 小脑出血
C. 脑桥出血
D. 脑室出血
E. 脑叶出血

正确答案：E。脑叶出血